婴儿Ⅲ°烧伤。第二个24小时每1%烧伤面积每公斤体重的额外补液量是
A. 0.5ml
B. 1.0ml
C. 1.2ml
D. 1.5ml
E. 1.8ml

正确答案：B。1.0ml

解析：根据八版外科学补液方案，伤后第1个24小时补液量：成人每1%Ⅱ⁰、Ⅲ⁰烧伤面积每公斤体重补充胶体液0.5ml和电解质液1ml，广泛深度烧伤者与小儿烧伤其比例可改为1：1，故该患儿每1%烧伤面积每公斤体重额外补液量为1.5ml。第二个24小时额外补液量为第一个24小时的一半，即0.75ml，但在实际临床应用中普遍认为此观点有误。七版外科学P183和七版黄家驷外科学P90都明确说明小儿烧伤后，第一个24小时每1%烧伤面积每公斤体重额外补液量为2.0ml，第二个24小时额外补液量为第一个24小时的一半，即1.0ml（B对）。